据《素问·阴阳应象大论》，“因其重”宜
A. 竭之
B. 决之
C. 扬之
D. 减之
E. 彰之

正确答案：D。减之

解析：“因其重而减之”意为由于邪气盛实在里而采用攻里泻下之法（D对）。“其在下者，引而竭之（A错）。血实宜决之（B错）。因其轻而扬之（C错）。因其衰而彰之（E错）。”